某人算得某资料的标准差为-3.4，可认为
A. 变量值都是负数
B. 变量值负的比正的多
C. 计算有错
D. 变量值多数为0
E. 变量值一个比一个小

正确答案：C。计算有错

解析：本题考查标准差的相关内容。标准差是方差的平方根，是非负数（C对ABDE错）。